第1躯体感觉中枢位于
A. 中央后回和中央旁小叶后部
B. 顶上小叶
C. 顶下小叶
D. 角回
E. 缘上回

正确答案：A。中央后回和中央旁小叶后部

解析：第I躯体感觉区位于中央后回和中央旁小叶后部（A对），接受背侧丘脑腹后核传来的对侧半身痛、温、触、压以及位置和运动觉。